上消化道不包括
A. 咽
B. 口腔
C. 胃
D. 十二指肠
E. 空肠

正确答案：E。空肠

解析：上消化道为从口腔到十二指肠的一部分管道，包括咽（A对）、口腔（B对）、胃（C对）、十二指肠（D对），而空肠属于下消化道(E错，为本题正确答案)。